治疗因痰饮引起的呕吐，除取主穴外，还应加
A. 脾俞、章门
B. 下脘、足三里
C. 上脘、行间
D. 梁门、内庭
E. 膻中、丰隆

正确答案：E。膻中、丰隆

解析：呕吐治以和胃降逆，理气止呕为法，主穴选取中脘、胃俞、内关、足三里，其因痰饮者，当祛痰化饮，取膻中、丰隆（E对）。加脾俞适用于脾胃虚寒（A错）。足三里为足阳明经合穴，疏理胃肠气机，通降胃气，为主穴（B错）。上脘可用于寒吐（C错）。梁门可用于食滞、内庭可用于热吐（D错）。